治疗手足口病邪犯肺脾证，应首选
A. 甘露消毒丹
B. 清瘟败毒饮
C. 银翘散
D. 清胃解毒汤
E. 普济消毒

正确答案：A。甘露消毒丹

解析：甘露消毒丹治疗手足口病邪犯肺脾，治法宣肺解表，清热化湿 方药用甘露消毒丹（A对）。银翘散治疗幼儿急疹邪郁肌表，治法 清热凉营，解毒祛湿（C错）。清胃解毒汤治疗水痘邪炽气营（D错）。普济消毒饮治疗流行性腮腺炎热毒壅盛，治法清热解毒，软坚散结（E错）。